在突发环境污染事件现场紧急医疗救助中，为了醒目辨认和分类处理，应在重伤人员的手臂上捆绑的纱布的颜色是
A. 黑色
B. 红色
C. 黄色
D. 绿色
E. 白色

正确答案：B。红色

解析：本题考查突发环境污染事件现场紧急医疗救助的相关内容。在突发环境污染事件现场紧急医疗救助中，为了醒目辨认和分类处理，应在重伤人员的手臂上捆绑的纱布的颜色是红色（B对ACDE错）。